股骨干骨折髓内针内固定的明确指征不包括
A. 非手术治疗失败
B. 伴有多发性损伤
C. 粉碎性骨折
D. 老年人不宜卧床过久者
E. 3岁以内儿童

正确答案：E。3岁以内儿童

解析：由于儿童骨的再塑能力强，随着生长发育，逐渐代偿，至成人后可不留痕迹，故儿童股骨干骨折多采用手法复位、小夹板固定、皮肤牵引维持方法治疗（E错，为本题正确答案）。股骨干骨折髓内针内固定为股骨干骨折的手术治疗措施，其手术治疗的指征包括非手术治疗失败（A对）、伴有多发性损伤（B对）、粉碎性骨折（C对）、老年人不宜卧床过久者（D对）。